适用于贵重药物和空气中易氧化药物干燥失重测定的方法是
A. 差示热分析法
B. 热重分析法
C. 差示扫描量热法
D. X射线粉未衍射法
E. 电泳法

正确答案：B。热重分析法